就服务对象而言，社区卫生服务中的综合性服务特点包括
A. 慢性病和传染病人
B. 妇女和儿童
C. 老人和成年人
D. 病人和非病人
E. 男人和女人

正确答案：D。病人和非病人

解析：本题考查社区卫生服务的综合性特点。社区卫生服务的综合性服务，就服务对象而言，不分年龄、性别、种族、文化背景、社会经济状况和疾患类型（D对ABCE错）。